对大气中某一污染源的污染现状进行监测时，在无风的情况下，其布点可选用
A. 四周布点
B. 扇形布点
C. 烟波下方布点
D. 几何状布点
E. 梅花布点

正确答案：A。四周布点

解析：本题考查布点方式的选择。对大气中某一污染源的污染现状进行监测时，在无风的情况下，其布点可选用四周布点（A对BCDE错）。